食物中毒系指人经口摄入了正常数量的含有生物性、化学性有毒物质的食品或把有毒有害物质当作食品摄入后所出现的非传染性急性或亚急性疾病，目前不包括
A. 亚硝酸钠食物中毒
B. 食用毒蘑菇引起的中毒
C. 食用发芽马铃薯引起的中毒
D. 食用未煮熟扁豆引起的中毒
E. 食源性寄生虫病

正确答案：E。食源性寄生虫病